能够与胆红素结合形成结合胆红素的是
A. 葡糖醛酸
B. 胆汁酸
C. 胆素原
D. 珠蛋白
E. 清蛋白

正确答案：A。葡糖醛酸

解析：在肝内，能够与胆红素结合形成结合胆红素的是葡糖醛酸（A对）。在滑面内质网UDP-葡糖醛酸基转移酶（UGT）的催化下，由UDPGA提供葡糖醛酸基，胆红素分子的丙酸基与葡糖醛酸以酯键结合，生成葡糖醛酸胆红素即结合胆红素。胆汁酸（B错）由胆固醇在肝内转化而成。胆素原（C错）由结合胆红素在肠内还原形成。珠蛋白（D错）与血红素结合形成血红蛋白。清蛋白（E错）是维持体内胶体渗透压的重要物质，还是体内多种物质的运输体。